下列哪项不属于职业性有害因素评价工作
A. 环境监测
B. 健康监护
C. 职业流行病学调查
D. 阈限值制定
E. 生物监测

正确答案：D。阈限值制定